慢性复发性腮腺炎好发于
A. 3～6岁儿童
B. 中年男性
C. 青春期男性
D. 青春期女性
E. 老年男性

正确答案：A。3～6岁儿童

解析：慢性复发性腮腺炎好发于3～6岁儿童和中年女性，表现为病因不明的反复唾液腺肿胀，可能与自身免疫相关。掌握“慢性唾液腺炎的病理变化”知识点。